循证医学就是
A. 系统评价
B. meta分析
C. 临床流行病学
D. 查找证据的医学
E. 最佳证据、临床经验和患者价值的有机结合

正确答案：E。最佳证据、临床经验和患者价值的有机结合